病人体验到脑内概念不断涌现，一个意念接着一个意念。该症状为
A. 强迫性思维
B. 思维奔逸
C. 联想散漫
D. 强制性思维
E. 思维插入

正确答案：B。思维奔逸

解析：兴奋性的思维联想加速和量的增多，新的概念一个接一个的不断涌现，内容丰富多彩是思维奔逸的表现（B对）。强迫思维表现为反复出现一些想法，明知不必要或不合理，但无法控制（A错）。联想散漫表现为在交谈时，内容散漫，缺乏主题，话题转换缺乏必要的联系（C错）。强制性思维表现为感到脑内涌现大量无现实意义、不属于自己的联想，是被外力强加的（D错）。思维插入患者感到某种不属于自己的思想被强行塞入（E错）。